前腭杆应位于
A. 腭皱襞处
B. 腭皱襞之后，上腭硬区之前
C. 上腭硬区
D. 上腭硬区之后
E. 颤动线之前

正确答案：B。腭皱襞之后，上腭硬区之前

解析：本题考查前腭杆。前腭杆位于上颌硬区（又叫腭隆突或上颌隆突）的前部，腭皱襞的后部，且与黏膜组织密合无压力（B对）。若位于腭皱襞（A错）处，会妨碍发音且有异物感。上颌硬区（C错）黏膜覆盖薄，义齿容易以此为支点翘动和压痛，应避开此处。后腭杆位于上颌硬区之后，颤动线之前（D错）。